医患沟通的基本原则不包括
A. 平等的原则
B. 共同参与和知情同意的原则
C. 诚信和公正的原则
D. 保密的原则
E. 救治原则

正确答案：E。救治原则